地高辛的作用机制系通过抑制下述哪种酶起作用
A. 磷酸二脂酶
B. 鸟苷酸环化酶
C. 腺苷酸环化酶
D. Na⁺，K⁺-ATP酶
E. 血管紧张素Ⅰ转化酶

正确答案：D。Na⁺，K⁺-ATP酶